女性，26岁，10天来全身皮肤出血点伴牙龈出血来诊。实验室检查：PLT35×109/L，临床诊断为慢性特发性血小板减少性紫癜（ITP）下列支持ITP诊断的实验室检查是
A. 凝血时间延长
B. 血块收缩良好
C. 抗核抗体阳性
D. 骨髓巨核细胞增多，产板型增多
E. 骨髓巨核细胞增多，幼稚型、颗粒型增多

正确答案：E。骨髓巨核细胞增多，幼稚型、颗粒型增多

解析：特发性血小板减少性紫癜诊断要点：①多次化验检查血小板减少。②脾不增大或轻度增大。③骨髓巨核细胞增多或正常，伴有成熟障碍。④具备下列5项中的任何一项：泼尼松治疗有效；脾切除治疗有效；血小板相关抗体（PAIg）阳性；血小板相关补体（PAC3）阳性；血小板寿命缩短。掌握“特发性血小板减少性紫癜（ITP）”知识点。